患者，女，39岁，已婚。已确诊为子宫肌瘤，症见带下绵绵，畏寒怯冷，四肢不温，遇寒则小腹疼痛，舌暗边有瘀斑，苔薄白，脉弦紧。治疗应首选
A. 桂枝茯苓丸
B. 血府逐瘀汤
C. 逐瘀止血汤
D. 真武汤
E. 理中汤

正确答案：A。桂枝茯苓丸

解析：本题患者有子宫肌瘤，脾阳被寒湿所遏，温化失职，水湿下注，带脉不固，则带下绵绵。寒邪伤阳，肢体失煦，则畏寒怯冷，四肢不温。寒邪犯胃，气机凝滞不通，则遇寒小腹疼痛。舌暗边有瘀斑，苔薄白，脉弦紧，为脾胃虚寒兼有瘀血之征，宜选桂枝茯苓丸（A对）；血府逐瘀汤具有活血化瘀，行气止痛之功效，主治胸中血瘀证。症见胸痛，头痛，日久不愈，痛如针刺而有定处，或呃逆日久不止，或饮水即呛，干呕，或内热瞀闷，或心悸怔忡，失眠多梦，急躁易怒，入暮潮热，唇暗或两目暗黑，舌质暗红，或舌有瘀斑、瘀点，脉涩或弦紧（B错）；逐瘀止血汤具有行血祛瘀，活血止痛之功效。主治妇人升高坠落，或闪挫受伤，以致恶血下流，有如血崩之状者。症见瘀血阻于胞中，经间期阳气内动，血海失宁，血络被伤，胸闷不舒，心烦易怒，小便色黄，大便干燥，舌色黯或有瘀点，脉细弦或弦数（C错）；真武汤具有温阳利水之功效。主治阳虚水泛证，症见畏寒肢厥，小便不利，心下悸动不宁，头目眩晕，身体筋肉瞤动，站立不稳，四肢沉重疼痛，浮肿，腰以下为甚；或腹痛，泄泻；或咳喘呕逆。舌质淡胖，边有齿痕，舌苔白滑，脉沉细（D错）；理中汤具有温中祛寒，补气健脾的功效，用于治疗脾胃虚寒证，症见自利不渴，呕吐腹痛，腹满不食及中寒霍乱，阳虚失血，如吐血、便血或崩漏，胸痞虚证，胸痛彻背，倦怠少气，四肢不温（E错）。